先用5%碳酸氢钠冲洗，继用清水冲洗，再用氧化镁甘油糊外涂
A. 硫酸灼伤
B. 氢氧化钠灼伤
C. 氧化钙灼伤
D. 苯酚灼伤
E. 沥青灼伤

正确答案：A。硫酸灼伤